马齿苋除能清热解毒外，又能
A. 凉血止血，通淋
B. 凉血止血，止痉
C. 凉血止血，润燥
D. 凉血止血，截疟
E. 凉血止血，活血

正确答案：A。凉血止血，通淋

解析：本题考查的是马齿苋的功效。马齿苋除能清热解毒外，又能（A对）。马齿苋：【功效】清热解毒，凉血止血，通淋。桑叶：【功效】疏散风热，清肺润燥，平肝明目，凉血止血（C错）。功效为凉血止血，止痉（B错）、凉血止血，截疟（D错）或凉血止血，活血（E错）的中药，2022年考试指南未明确说明。